感染占口腔疣状癌的40%的是
A. 人类乳头瘤病毒亚型6和11
B. 人类乳头瘤病毒亚型6和33
C. 人类乳头瘤病毒亚型16和18
D. 人类乳头瘤病毒亚型16和33
E. 人类乳头瘤病毒亚型11和33

正确答案：C。人类乳头瘤病毒亚型16和18

解析：人类乳头瘤病毒亚型16和18感染占口腔疣状癌的40%。掌握“口腔黏膜鳞癌及疣状癌”知识点。